肩胛下肌、大圆肌瘫痪可能是下列何神经损伤
A. 肩胛背神经
B. 肩胛上神经
C. 胸长神经
D. 肩胛下神经
E. 无

正确答案：D。肩胛下神经

解析：肩胛下神经（D对）支配肩胛下肌和大圆肌的运动，损伤后可导致该二肌瘫痪。肩胛背神经（A错）分布于菱形肌和肩胛提肌。肩胛上神经（B错）分布于冈上肌、冈下肌和肩关节。胸长神经（C错），分布于前锯肌和乳房外侧份。